不属于甲型肝炎病毒特点的是
A. 属于无包膜小RNA病毒
B. 主要经粪-口传播
C. 预后不良可诱发肝癌
D. 病后可获持久免疫
E. 可用灭活或减毒活疫苗预防

正确答案：C。预后不良可诱发肝癌